治燥热咳嗽宜用
A. 二母宁嗽丸
B. 清肺抑火丸
C. 苏子降气丸
D. 镇咳宁糖浆
E. 川贝止咳露

正确答案：A。二母宁嗽丸

解析：本题考查的是二母宁嗽丸的主治。治燥热咳嗽宜用二母宁嗽丸（A对）。二母宁嗽丸：【主治】燥热蕴肺所致的咳嗽，症见痰黄而黏不易咳出、胸闷气促、久咳不止、声哑喉痛。清肺抑火丸（B错）：【主治】痰热阻肺所致的咳嗽、痰黄黏稠、口干咽痛、大便干燥。苏子降气丸（C错）：【主治】上盛下虚、气逆痰壅所致的咳嗽喘息、胸膈满闷。川贝止咳露（E错）：【主治】风热咳嗽，痰多上气或燥咳。镇咳宁糖浆（D错）的主治，2022年考试指南未明确说明。